患者上前牙因中龋一次树脂充填后2月，一直冷热疼，无自发痛。查：左右上1近中面复合树脂充填物，无继发龋，叩（-），冷测疼痛，去除刺激可缓解。该牙处理为
A. 观察
B. 去除旧充填物，氧化锌丁香油糊剂安抚
C. 去除旧充填物，复合树脂重新充填
D. 去除旧充填物，玻璃离子水门汀充填
E. 牙髓治疗

正确答案：B。去除旧充填物，氧化锌丁香油糊剂安抚

解析：本题考查充填后疼痛。患者上前牙因中龋一次树脂充填后2月，一直冷热疼，无自发痛。查：左右上1近中面复合树脂充填物，无继发龋，叩（-），冷测疼痛，去除刺激可缓解。该牙处理为去除旧充填物，氧化锌丁香油糊剂安抚（B对）。根据病例描述，患牙中龋一次性树脂充填后2月，一直冷热痛，无自发痛，表明有牙髓充血症状；无继发龋，叩（-），冷测疼痛，去除刺激可缓解，考虑患牙为可复性牙髓炎，应去除旧充填物，氧化锌丁香油糊剂安抚，以缓解牙髓充血症状。激发痛较轻者，可观察，如症状逐渐缓解可不处理（A错）。牙髓已有充血症状，去除旧充填物，复合树脂或玻璃离子水门汀重新充填，并不能缓解牙髓的症状（CD错）。牙髓治疗适用于不可复性牙髓炎，该患牙为可复性牙髓炎，无需牙髓治疗（E错）。